调节胰液分泌的神经体液因素不包括
A. 迷走神经兴奋
B. 促胃液素
C. 促胰液素
D. 支配胰的内脏大神经
E. 血管活性肠肽

正确答案：D。支配胰的内脏大神经